与醛固酮竞争醛固酮受体的药物是
A. 乙酰唑胺
B. 安体舒通
C. 氨苯蝶啶
D. 氢氯噻嗪
E. 呋喃苯胺酸

正确答案：B。安体舒通

解析：本题考查利尿药。与醛固酮竞争醛固酮受体的药物是安体舒通（B对）。安体舒通即螺内酯，为醛固酮的竞争性拮抗剂，可竞争性地与胞浆中的醛固酮受体结合而拮抗醛固酮的保钠排钾作用，促进Na⁺和水的排出，减少K⁺的排出。乙酰唑胺（A错）为碳酸酐酶抑制剂。氨苯蝶啶（C错）肾小管上皮细胞Na⁺通道抑制剂。氢氯噻嗪（D错）为中效利尿药。呋喃苯胺酸（E错）即呋塞米，为高效利尿药。